下列生命质量测评量表中是目前被普遍认可的有
A. 疾病影响量表
B. 癌症病人生活功能指数
C. 健康调查量表
D. 健康良好状态指数

正确答案：C。健康调查量表

解析：本题考查目前被普遍认可的生命质量测评量表。目前被普遍认可的生命质量测评量表是健康调查量表（C对ABD错），也称36条目简明健康量表，是美国波士顿健康研究所在医疗结果研究调查表的基础上开发出来的通用型简明健康调查问卷，它适用于普通人群的生命质量测量、临床试验研究和卫生政策评价等。